下列关于RNA分子中“帽子”的叙述哪一项是正确的
A. 可使tRNA进行加工过程
B. 存在于tRNA的3'端
C. 是由聚A组成
D. 存在于真核细胞的mRNA 5'端
E. 用于校正原核细胞mRNA翻译中的错误

正确答案：D。存在于真核细胞的mRNA 5'端